基因工程的基本过程不包括
A. 载体和目的基因的分离
B. 限制性内切酶的切割
C. DNA重组体的形成及转化
D. 蛋白质空间结构的测定
E. 重组体的筛选与鉴定

正确答案：D。蛋白质空间结构的测定